“水火既济”的“水火”所指的脏是
A. 心、脾
B. 肝、肺
C. 脾、肾
D. 心、肾
E. 肝、肾

正确答案：D。心、肾

解析：心居上属阳，在五行属火；肾居下属阴，在五行属水。心火须下降于肾，使肾水不寒；肾水须上济于心，使心火不亢。水火既济指心与肾水火升降互济，才能维持两脏之间生理机能的协调平衡（D对）。心与脾（A错）的关系，主要表现在血液生成与运行的相互作用、相互协调。肺与肝（B错）的关系，主要表现人体气机升降调节方面。脾与肾（C错）的关系，主要表现在先天和后天相互滋生与津液代谢方面。肝与肾（E错）的关系，主要表现在“肝肾同源”，包括精血同源，藏泄互用，阴阳互资互制。